丙戊酸钠的严重毒性是
A. 肝功能损害
B. 再生障碍性贫血
C. 抑制呼吸
D. 口干、皮肤干燥
E. 低血钙

正确答案：A。肝功能损害

解析：本题考查丙戊酸钠的不良反应。丙戊酸钠的严重毒性是肝功能损害（A对）。再生障碍性贫血（B错）是一组由多种病因造成的骨髓造血功能障碍。巴比妥类药物（C错）不良反应为呼吸抑制。丙戊酸钠可见皮肤感染，不出现口干、皮肤干燥（D错）。氢氯噻嗪大剂量可引起血钙降低（E错）。